巴比妥类药物急性中毒致死的直接原因是
A. 肝脏损害
B. 循环衰竭
C. 深度呼吸抑制
D. 昏迷
E. 继发感染

正确答案：C。深度呼吸抑制

解析：本题考查药物的不良反应。巴比妥类药物急性中毒致死的直接原因是深度呼吸抑制（C对）。急性中毒以中枢神经抑制为主，且明显影响呼吸、心血管及消化系统。巴比妥中毒还可以引起其他次要症状，如幻觉，全身反应迟缓，昏迷逐渐加深（D错），肝脏损害（A错），血流动力学及微循环等循环系统的症状（B错）。继发感染（E错）是指当患者患有某种疾病，且还没治愈，此时因机体免疫力下降导致机体又受到病毒、细菌、真菌等感染的现象。